关于再生障碍性贫血的诊断，下列选项错误的是
A. 肝、脾肿大
B. 全血细胞减少
C. 骨髓多部位增生减低
D. 发热、出血、贫血
E. 淋巴细胞比例增高

正确答案：A。肝、脾肿大

解析：再生障碍性贫血（AA）简称再障，是一种可能由不同病因和机制引起的骨髓造血功能低下、全血细胞减少和贫血、出血、感染综合征，免疫抑制治疗有效。再生障碍性贫血的临床表现主要有发热、出血、贫血（D对），全血细胞减少（B对），淋巴细胞比例增高（E对），骨髓多部位增生减低（C对），一般无肝脾肿大（A错，为本题正确答案）。